外源性凝血系统的触发是由于组织细胞损伤释放出的组织因子与下列哪一凝血因子结合而开始的？
A. 凝血因子X
B. 凝血因子IX
C. 凝血因子XI
D. 凝血因子VⅢ
E. 凝血因子VⅡ

正确答案：E。凝血因子VⅡ

解析：少量激活的凝血因子Vll(FVlla)可能存在血液中，组织细胞损伤释放出的组织因子与凝血因子Vll（E对ABCD错）结合而开始激活外源性凝血系统。